5岁男孩，生长发育迟缓，畏食，有异食癖。1个月前，手部划伤，伤口一直没有愈合。其最有可能缺乏哪种微量元素
A. 铬
B. 铜
C. 硒
D. 锌
E. 钴

正确答案：D。锌